男，30岁。外伤后急性失血约1000ml，给予手术止血，并输注平衡盐溶液和羟乙基淀粉。术后查体：P95次/分，BP100/60mmHg，Hb80g/l。此时应采取的治疗措施是
A. 输注红细胞悬液1单位
B. 输注红细胞悬液5单位
C. 输注全血1000ml
D. 输注血浆400ml
E. 暂不输血，继续观察

正确答案：E。暂不输血，继续观察

解析：该患者急性失血1000ml，但已及时给予手术止血，并输注了平衡盐溶液和羟乙基淀粉（血浆代用品），生命体征已基本平稳，Hb达80g/L。根据2000年卫生部输血指南建议：Hb为70～100g/L时，应根据病人的具体情况来决定是否输血。对于可输可不输的病人应尽量不输。因此该患者此时应暂不输血，继续观察（E对）。